肥皂刷手法中需将上肢浸泡在70%乙醇内，其浸泡范围至少是手至肘上
A. 2cm
B. 4cm
C. 6cm
D. 8cm
E. 10cm

正确答案：C。6cm

解析：传统的手臂消毒法为肥皂水刷洗同乙醇浸泡，肥皂水刷手时刷洗范围至少是手至肘上10cm，而乙醇浸泡时浸泡范围至少是手至肘上6cm（C对），需要15分钟才能完成，现在已很少使用，八版外科学已删除相关知识点。